有关地高辛的叙述，下列哪项是错误的
A. 口服时肠道吸收较完全
B. 同服广谱抗生素可减少其吸收
C. 血浆蛋白结合率约25％
D. 主要以原形从肾排泄
E. 肝肠循环少

正确答案：B。同服广谱抗生素可减少其吸收

解析：本题考查地高辛。广谱抗生素可改变肠道内寄生菌群的生长，使迟缓真杆菌的转化作用受到抑制，从而减少地高辛的转化，令其生物利用度和血清药物浓度增加（B错，为本题正确答案）。口服地高辛的生物利用度约为80%（A对），血浆蛋白结合率约25％（C对），肝肠循环少（E对），主要以原型药物从尿液中排出（D对）。